非经胃肠道给药的剂型有
A. 注射给药剂型
B. 呼吸道给药剂型
C. 皮肤给药剂型
D. 黏膜给药剂型
E. 阴道给药剂型

正确答案：A、B、C、D、E。注射给药剂型；呼吸道给药剂型；皮肤给药剂型；黏膜给药剂型；阴道给药剂型

解析：本题考查非经胃肠道给药的剂型。非经胃肠道给药的剂型有注射给药剂型（A对）、呼吸道给药剂型（B对）、皮肤给药剂型（C对）、黏膜给药剂型（D对）、阴道给药剂型（E对）。非经肠道给药剂型是指除胃肠道给药途径以外的其它所有剂型，包括注射给药、皮肤给药、口腔给药、鼻腔给药、肺部给药、眼部给药、直肠、阴道和尿道给药等。注射给药剂型主要包括静脉注射、肌内注射、皮下注射以及皮内注射等；呼吸道给药剂型属于吸入给药，给药剂型有吸入气雾剂、供雾化用的的液体制剂和吸入粉雾剂等；皮肤给药剂型：如外用溶液剂、洗剂、软膏剂、贴剂、凝胶剂等；黏膜给药剂型：如滴眼剂、滴鼻剂、眼用软膏剂、含漱剂、舌下片剂等；阴道给药剂型属于腔道给药剂型，腔道给药剂型包括栓剂、气雾剂等，用于直肠、阴道、尿道、鼻腔、耳道等。